患者先见高热口渴，汗出，后出现消瘦，面色淡白，气短乏力，脉细无力，其临床意义是
A. 实证转虚
B. 热证转寒
C. 表热里寒
D. 真寒假熟
E. 虚实夹杂

正确答案：A。实证转虚

解析：邪正斗争，病情日久不愈，或失治误治，正气伤而不足以御邪，则可形成实证转化为虚证。患者先是出现高热口渴，汗出的实热症状，久治不愈，导致气耗，出现消瘦，面色淡白，气短乏力，脉细无力的虚象；故其临床意义为实证转虚（A对）。热证转寒指原为热证，后出现寒证，而热证随之消失（B错）。表寒里热如先有表寒未罢，又入里化热，或先有里热之人，复感风寒之邪，出现恶寒发热、无汗、头身疼痛、口渴喜饮、烦躁、便秘尿黄、舌红苔黄等（C错）。真寒假热证是指疾病的本质为寒证，却出现某些“热象”，又称“寒极似热”（D错）。虚实夹杂是指在同一患者身上，既有虚证，又有实证的情况（E错）。